产后出血的治疗原则是
A. 塞流、澄源、复旧
B. 急则治其标，缓则治其本
C. 调理气血冲任
D. 虚者补之，实者泻之
E. 热者清之，逆则降之

正确答案：B。急则治其标，缓则治其本

解析：产后出血属于产科危重症，治疗应以止血、固脱为先，出血量多势急时，中医应以独参汤或参附汤益气固冲，回阳救逆；西医则以促宫缩、抗感染、纠正贫血等短时间内控制出血。若宫内有胎盘胎膜残留者，应行清宫术；子宫伤口裂开者，必要时手术治疗。当病情得到有效控制后，应通过中医辨证论治，以治其本，巩固疗效。根据病情的轻重缓急，采用急则治其标，缓则治其本的原则以调理气血、固摄冲任为主要治法。当出血量多势急时，急宜益气固冲，回阳救逆。待血势缓解，则应虚者补之，热者清之，瘀者攻之，并随证选加相应止血药标本同治（B对）。